化妆品中下列哪些物质规定限量要求
A. 汞、砷、铅、甲醛
B. 汞、砷、铅、甲醇
C. 汞、砷、铅、镍
D. 镍、汞、砷、甲醛
E. 镍、汞、砷、甲醇

正确答案：B。汞、砷、铅、甲醇